胸闷，心前区刺痛，心悸，气短，乏力，舌紫，脉细。宜选用的中成药是
A. 速效救心丸
B. 益心舒胶囊
C. 丹蒌片
D. 冠心苏合滴丸
E. 活心丸

正确答案：E。活心丸

解析：本题考查的是胸痹的辨证论治。胸闷，心前区刺痛，心悸，气短，乏力，舌紫，脉细。宜选用的中成药是活心丸（E对）。胸痹是指以胸部闷痛，甚则胸痛彻背，短气、喘息不得卧为主症的疾病，轻者仅感胸闷如窒，呼吸欠畅，重者则有胸痛，严重者心痛彻背，背痛彻心。西医学的冠心病（心绞痛或心肌梗死）、其他原因引起的心绞痛（如主动脉瓣狭窄、梗阻性肥厚型心肌病）、心包炎以及肺源性心脏病等以上述表现为主者，可参考此内容辨证论治。胸痹之气滞血瘀证【症状】心胸疼痛，如刺如绞，痛有定处，入夜为甚，重者心痛彻背，背痛彻心，或痛引肩背，伴有胸闷，日久不愈，可因暴怒、劳累而加重。舌质紫暗，有瘀斑，苔薄，脉弦细。【中成药应用】常用中成药有血府逐瘀口服液、速效救心丸（A错）、复方丹参滴丸、冠心丹参滴丸、银丹心脑通软胶囊。胸痹之气阴两虚证【症状】胸闷隐痛，时作时止，心悸气短，动则益甚，伴倦怠懒言，易汗出，头晕，失眠多梦。舌红或淡红，舌体胖且边有齿痕，苔薄白或少，脉细缓或结代。【中成药应用】常用中成药有益心胶囊、益心舒胶囊（B错）、益心通脉颗粒、冠心生脉口服液、洛布桑胶囊。胸痹之痰浊痹阻证【症状】胸闷重而心痛微，痰多气短，肢体沉重，形体肥胖，遇阴雨天而易发作或加重，伴有倦怠乏力，纳呆便溏，咳吐痰涎。舌体胖大且边有齿痕，苔浊腻或白滑，脉滑。【中成药应用】常用中成药有血滞通胶囊、丹蒌片（C错）、舒心降脂片、降脂通络软胶囊。胸痹之寒凝心脉证【症状】猝然心痛如绞，心痛彻背，喘不得卧，多因气候骤冷或骤感风寒而发病或加重，伴形寒，甚则手足不温，冷汗自出，胸闷气短，心悸，面色苍白。舌质紫暗，或有瘀斑瘀点，苔薄，脉沉紧或沉细。【中成药应用】常用中成药有宽胸气雾剂、苏合香丸、冠心苏合滴丸（D错）、神香苏合丸（庆余救心丸）。